祛斑霜可以引起
A. 刺激性接触性皮炎
B. 变应性接触性皮炎
C. 化妆品光感性皮炎
D. 化妆品痤疮
E. 化妆品皮肤色素异常

正确答案：A。刺激性接触性皮炎